女，32岁，继发性痛经伴经量增多4年，妇科检查：子宫后位，呈孕10周大小，活动欠佳，双附件未触及异常，最可能诊断是
A. 子宫肉瘤
B. 子宫腺肌病
C. 子宫肌瘤
D. 子宫内膜异位症
E. 子宫内膜炎

正确答案：B。子宫腺肌病

解析：该患者女，32岁，继发性痛经伴经量多4年（子宫腺肌病的表现），妇科检查：子宫后位，呈孕10周大小，活动欠佳，双附件未触及异常（子宫腺肌病的妇科检查表现），结合患者的表现和辅助检查，最可能诊断是子宫腺肌病（B对）。（P310）子宫肉瘤最常见的症状为阴道不规则流血伴腹痛，确诊依据是组织学诊断（A错）。（P303）子宫肌瘤 临床表现与肌瘤的类型、大小和有无变性相关，最常见的症状是月经改变（C错）。（P261）子宫内膜异位症 主要症状为下腹痛与痛经、不孕及性交不适（D错）。（P220）子宫感染包括急性子宫内膜炎、子宫肌炎。病原体经胎盘剥离面侵入，扩散至子宫蜕膜层称为子宫内膜炎，侵入子宫肌层称为子宫肌炎，两者常伴发。若为子宫内膜炎，子宫内膜充血、坏死，阴道内有大量脓性分泌物且有臭味（E错）。